普萘洛尔用于治疗
A. 心律失常
B. 高血压
C. 甲状腺机能亢进
D. 糖尿病
E. 心绞痛

正确答案：A、B、C、E。心律失常；高血压；甲状腺机能亢进；心绞痛

解析：本题考查普萘洛尔。普萘洛尔用于治疗心律失常（A对）、高血压（B对）、甲状腺机能亢进（C对）、心绞痛（E对）。普萘洛尔主要用于治疗室上性心律失常。对交感神经兴奋性增高、甲状腺功能亢进及嗜铬细胞瘤等引起的窦性心动过速效果好。普萘洛尔用于治疗各种程度的原发性高血压，可单独使用，也可与其他抗高血压药合用。对心输出量及肾素活性偏高者疗效较好，高血压伴有心绞痛、偏头痛、焦虑症等选用β受体拮抗药较为合适。普萘洛尔可治疗稳定型及不稳定型心绞痛，可减少发作次数，对兼患高血压或心律失常者更为适用。普萘洛尔通过阻断靶器官的交感神经肾上腺能受体的活性，达到抑制儿茶酚胺升高的作用。从而改善甲亢患者烦躁、怕热、多汗、心动过速等症状。另外还能抑制外周组织T₄转化为T₃，阻断甲状腺激素对心肌的直接作用。